是按一定方式以同等的概率抽样，可以使用抽签的方式，也可以使用随机数字表来抽取样本的调查方法是
A. 单纯随机抽样
B. 系统抽样
C. 分层抽样
D. 整群抽样
E. 多级抽样

正确答案：A。单纯随机抽样

解析：单纯随机抽样：它是按一定方式以同等的概率抽样，称单纯随机抽样。可以使用抽签的方式，也可以使用随机数字表来抽取样本。掌握“口腔健康状况调查的目的、项目、标准及方法”知识点。